医学道德修养的根本途径是
A. 医疗实践
B. 理论学习
C. 自我反省
D. 慎独
E. 自律

正确答案：A。医疗实践

解析：医学道德修养的目的是使医务人员逐渐达到较高的医德境界，根本途径在于医学实践（A对）。理论学习过程中的内省，是在学习相关医学伦理理论时，省察自己对相关知识的真实认识、情感，觉察自己认识的正确性，及时修正自己错误的观点及其情感体验。只有通过这样的内省过程，才能将医学伦理的基本准则有效整合成为人生价值观的有机内容，才能够内化为职业态度，才能够真正发挥作用（B错）。医学道德修养的内省方法，是指医务人员根据医德理论、原则和规范，对自己医学伦理学习和执业行为过程，主动或被动地进行自我评价、判断、批评、改造，并以此为起点，自我促进医学道德水平进步的方法（C错）。在医学道德修养层面，“慎独”相对于“共处”而言，是指医务人员在无人知晓与评价时，自觉按照医学道德要求实践医德行为的境界（D错）。自律是指自觉地遵循内心认同的道德规范进行自我指导，并以此进行自我反省、自我提升的过程，表现出对内心道德准则的服从，控制力量是内部的自我肯定或批评，个体关注的重点是行为的动机（E错）。